全口义齿初戴时发现下颌明显后退，其原因是
A. 人工牙排列不当
B. 患者下颌骨过于后退
C. 确定水平颌位关系时，下颌前伸
D. 垂直距离过高
E. 垂直距离过低

正确答案：C。确定水平颌位关系时，下颌前伸

解析：如果患者在确定颌位关系时下颌前伸，戴义齿后就会出现下颌义齿后退现象。表现为上下前牙水平开（牙合），垂直距离增高。如果仅有很小范围的后退，可适当调改有关的牙尖即可。若后退的范围较大，必须返工重新确定颌位关系。掌握“全口义齿颌位关系及上（牙合）架”知识点。